中枢性瘫痪的特点是
A. 肌张力降低
B. 腱反射减弱
C. 浅反射消失
D. 无病理反射
E. 肌张力增强

正确答案：E。肌张力增强

解析：中枢性瘫痪又称上运动神经元性瘫痪，或称痉挛性瘫痪、硬瘫，是由于大脑皮层运动区锥体细胞及其发生的下行纤维-锥体束受损所产生。由于上运动神经元受损，失去了对下运动神经元的抑制调控作用，使脊髓的反射功能“释放”，产生随意运动减弱或消失，临床上主要表现肌张力增高（E对A错），腱反射亢进（B错），出现病理反射（D错），但无肌肉萎缩，呈痉挛性瘫痪。肌电图显示神经传导正常，无失神经支配电位。浅反射（C错）不会消失。